检查一批花生油时发现，黄曲霉毒素B1含量为10μg/kg，对该批食品的处理是
A. 可食用
B. 不可食用
C. 经处理可食用
D. 经处理后工业用
E. 销毁处理

正确答案：A。可食用